某县药品监督管理部门对当地一家药品零售企业（经营范围：化学药、生物制品、中成药、中药饮片）进行日常检查的过程中，发现其人员包括：法定代表人甲：具备执业药师资格（药学），2015年开办该药品零售企业，注册的执业单位为该药品零售企业。执业药师（中药学）乙：具备执业药师资格（中药学），注册在该药品零售企业。店员丙：某大专院校药学专业毕业后一直在该药品零售企业工作。检查当日上午，甲与乙外出参加继续教育，丙在岗。检查期间，有消费者丁到店，向丙表示欲购买罗红霉素片1盒（生产企业为国外某制药有限公司，2020年8月获批在中国上市），甲类非处方药通便灵胶囊1盒，但因时间匆忙，没来得及前往医院就诊开具处方。关于丁欲购买的罗红霉素片，其药品批准文号格式正确的是
A. 国药准字HJ2020XXXX
B. 进口药品注册证号HJ2020XXXX
C. 国药准字HZ2020XXXX
D. 国药准字H2020XXXX

正确答案：A。国药准字HJ2020XXXX

解析：本题考查生产药品批准文号格式。其药品批准文号格式正确的是国药准字HJ2020XXXX（A对）。第一百二十三条境内生产药品批准文号格式为：国药准字H（Z、S）+四位年号+四位顺序号（D错）。中国香港、澳门和台湾地区生产药品批准文号格式为：国药准字H（Z、S）C+四位年号+四位顺序号。境外生产药品批准文号格式为：国药准字H（Z、S）J+四位年号+四位顺序号（B错）。其中，H代表化学药，Z代表中药（C错），S代表生物制品。